牙周夹板的适应证，不正确的一项是
A. 外伤引起的有保留价值的松动牙
B. 牙周病导致的牙齿松动Ⅲ度
C. 牙周手术前固定患牙
D. 口腔卫生保持良好
E. 牙周炎症已基本控制者

正确答案：B。牙周病导致的牙齿松动Ⅲ度

解析：牙周夹板适应证：①牙周炎松动牙经牙周治疗后，牙松动仍较明显且有咀嚼不适等症状，如牙列完整，可作牙齿结扎以利牙周组织的修复再生。②松动牙在手术前需固定，以利于手术操作和术后的愈合。由于固定的力量不大，故只用于前牙。③因外伤而松动的牙，用夹板固定后，有利于牙周组织的修复，一般固定8周后便可拆除。牙周病导致牙齿Ⅲ度松动的牙齿为拔除的指征，不是牙周夹板的适应症。掌握“慢性牙周炎的治疗原则、程序及方法”知识点。